下列各项，不属于保和丸组成药物的是
A. 山楂
B. 麦芽
C. 半夏
D. 茯苓
E. 神曲

正确答案：B。麦芽

解析：本题考查方剂的组成，保和丸的组成有山楂、神曲、半夏、茯苓、陈皮、连翘、莱菔子，没有麦芽（B对）。